临床使用时有处方限量的药品是
A. 麻醉药品
B. 第二类精神药品
C. 两者均是
D. 两者均不是

正确答案：C。两者均是

解析：本题考查处方限量。临床使用时有处方限量的药品是麻醉药品、精神药品（C对）、医疗用毒性药品、放射性药品。第二类精神药品一般每张处方不得超过7日常用量；对于慢性病或某些特殊情况的患者，处方用量可以适当延长，医师应当注明理由。